由逍遥散变化为黑逍遥散，属于
A. 药物加减的变化
B. 药量增减的变化
C. 剂型更换的变化
D. 药物加减和药量增减变化的联合运用
E. 药量增加和剂型更换变化的联合运用

正确答案：A。药物加减的变化

解析：该题考查方剂的变化形式。方剂的运用变化主要有药味增减的变化，药量增减的变化，剂型更换的变化，其变化形式可单独应用，也可相互结合应用。黑逍遥散是在逍遥散的基础上加熟地黄而成，属药物加减的变化（A对）。